关于某病病死率和死亡率的叙述，正确的是
A. 前者用于医院人群，后者用于社区人群
B. 某病的病死率和死亡率都反映疾病对人群的危害程度
C. 某病死亡率和病死率都反映疾病的严重程度
D. 某病死亡率反映疾病对人群的危害程度，而病死率反映疾病的严重程度
E. 两者计算的分母相同

正确答案：D。某病死亡率反映疾病对人群的危害程度，而病死率反映疾病的严重程度